皮肤不是产生以下哪种感觉的感受器
A. 痛觉
B. 触觉
C. 温度觉
D. 本体觉
E. 压觉

正确答案：D。本体觉

解析：皮肤内含有多种感受器，如接受痛（A对）、温（C对）、触（B对）、压觉（E对，故D为本题正确答案）等刺激的感受器。